通过对样本实际数据排队编秩后，基于秩次进行比较的非参数检验称为
A. 卡方检验
B. t检验
C. P检验
D. z检验
E. 秩和检验

正确答案：E。秩和检验

解析：秩和检验是通过对样本实际数据排队编秩后，基于秩次进行比较的非参数检验。掌握“秩和检验、直线回归和线性分析”知识点。